完全康复时
A. 损伤性变化得到控制
B. 损伤性变化完全消失
C. 两者均有
D. 两者均无
E. 无

正确答案：B。损伤性变化完全消失

解析：完全康复是指疾病所致的损伤完全消失（B对），机体的功能、代谢及形态完全恢复正常。